合成磷脂时，除消耗ATP外，还消耗
A. ATP
B. CTP
C. GTP
D. UTP
E. TTP

正确答案：B。CTP